鼻根部与眼内眦之间有压痛提示何部位病变
A. 上颌窦
B. 筛窦
C. 额窦
D. 蝶窦
E. 视网膜

正确答案：B。筛窦

解析：各鼻窦区的压痛检查：筛窦（B对）：双手固定病人两侧耳后/双侧拇指分别置于鼻根部与眼内眦之间向后方按压，询问有无压痛。上颌窦（A错）：医师双手固定于病人的两侧耳后，将栂指分别置于左右颧部向后按压，询问有无压痛，并比较两侧压痛有无区别。也可用右手中指指腹叩击颧部，并询问有否叩痛。额窦（C错）：一手扶持病人枕部，用另一拇指或食指置于眼眶上缘内侧用力向后向上按压；或以两手固定头部，双手栂指置于眼眶上缘内侧向后、向上按压，询问有无压痛，两侧有无差异。也可用中指叩击该区，谉问有无叩击痛。蝶窦（D错）：因解剖位置较深，不能在体表进行检查。视网膜（E错）居于眼球壁的内层，是一层透明的薄膜，视网膜由色素上皮层和视网膜感觉层组成，两层间在病理情况下可分开。